治疗肺热咳嗽，胃热呕吐，应选用的药物是
A. 竹茹
B. 白果
C. 半夏
D. 瓜蒌
E. 紫菀

正确答案：A。竹茹

解析：治疗肺热咳嗽，当清肺化痰；治疗胃热呕吐，当清胃热。竹茹甘、微寒，善于清化热痰。治肺热咳嗽，痰黄质稠者，常与黄芩、桑白皮等同用，以增强清热化痰功效；且能清热降逆止呕，为治胃热呕逆之要药，治疗胃热呕逆，常配伍黄连、黄芩、生姜等药（A对）。白果能敛肺定喘，治疗喘咳痰多；能止带缩尿，治疗带下白浊，遗尿尿频，且性平，不能清肺胃之热（B错）；半夏虽能燥湿化痰，降逆止呕，但半夏性味辛温，适用于寒痰咳嗽，以及痰饮或胃寒所致的胃气上逆呕吐（C错）；瓜蒌能清肺热，治疗肺热咳嗽，但不能治疗胃热呕吐（D错）；紫菀能润肺下气，化痰止咳，能治疗疲多喘咳，新久咳嗽，劳嗽咳血，无论寒热均可，紫菀但入肺经，不入胃经，不能清胃热止呕（E错）。